促胃肠动力药适宜给药时间是
A. 清晨
B. 餐前
C. 餐中
D. 餐后
E. 睡前

正确答案：B。餐前

解析：本题考查药品服用的适宜时间。促胃肠动力药在餐前（B对）服用帮助消化。适宜清晨（A错）服用的药物有糖皮质激素类、抗高血压药物、抗抑郁药、利尿药、驱虫药、泻药。适宜餐中（C错）服用的药物有助消化药、肝胆辅助用药、减肥药、抗结核药。适宜餐后（D错）服用的药物有非甾体抗炎药、维生素、组胺H₂受体阻断剂。适宜睡前（E错）服用的药物有催眠药、平喘药、调节血脂药、抗过敏药、钙剂、缓泻药。